IgM的一个特点是
A. 在胃肠道局部大量分泌
B. 在初次体液免疫应答中最早出现
C. 能够穿过胎盘屏障
D. 介导ADCC作用
E. 介导Ⅰ型超敏反应

正确答案：B。在初次体液免疫应答中最早出现